患者，女，60岁，初戴全口义齿，医师检查发现在正中（牙合）接触时，咬合接触点少此现象诊断为
A. 正中关系错误
B. 正中（牙合）接触不全
C. 前伸（牙合）干扰
D. 侧方（牙合）干扰
E. 长正中不协调

正确答案：B。正中（牙合）接触不全

解析：此患者全口义齿正中（牙合）检查时，接触点少，可以诊断为正中（牙合）干扰。掌握“全口义齿初戴”知识点。